风湿痹痛兼有表证者，当选用
A. 秦艽
B. 独活
C. 威灵仙
D. 桑枝
E. 桑寄生

正确答案：B。独活

解析：独活辛散苦燥温通，能发散风寒湿邪而解表，多用于治疗风湿痹痛兼有表证者（B对）。秦艽（A错）辛散苦泄，质偏润而不燥，为风中之润剂，筋脉拘挛，骨节酸痛，无论寒热新久，均可配伍应用。威灵仙（C错）辛散温通，性猛善走，既能祛风湿，又能通经络而止痛，为治风湿痹痛要药。桑枝（D错）性平，祛风湿而善达四肢经络，通利关节，痹证新久寒热均可应用，尤宜于风湿热痹，肩臂、关节酸痛麻木者。桑寄生（E错）苦燥甘补，既能祛风湿，又长于补肝肾，强筋骨，对痹症日久损及肝肾，腰膝酸软，筋骨无力者尤宜。